十二经脉的命名，主要包括了下列哪些内容
A. 阴阳、五行、脏腑
B. 五行、手足、阴阳
C. 手足、阴阳、脏腑
D. 脏腑、手足、五行
E. 以上均非

正确答案：C。手足、阴阳、脏腑

解析：十二经脉的名称是古人根据阴阳消长所衍化的三阴三阳，结合经脉循行于上肢和下肢的特点，以及与脏腑相属络的关系而定的，故十二经脉的命名主要包含了手足、阴阳、脏腑（C对）。